无中枢作用的H₁受体阻断药是
A. 阿司咪唑
B. 西替利嗪
C. 苯海拉明
D. 吡咯醇胺
E. 赛庚啶

正确答案：A。阿司咪唑

解析：本题考查磺胺的抗菌机制。磺胺的抗菌机制是影响叶酸代谢（A对）。磺胺药与PABA竞争二氢叶酸合成酶，影响了二氢叶酸的合成，因而使细菌生长和繁殖受到抑制。影响胞浆膜通透性（B错）的药物是多黏菌素、制霉菌素、两性霉素B等。抑制细菌细胞壁的合成（C错）的药物是β-内酰胺酶类抗菌药。抑制蛋白质合成（D错）的药物是氨基糖苷类、四环素类、氯霉素类、林可霉素类、大环内酯类等。抑制核酸合成（E错）的药物是喹诺酮类抗生素。